肝肾不足，肾精不固，宜用
A. 当归
B. 龙眼肉
C. 何首乌
D. 白芍
E. 阿胶

正确答案：C。何首乌

解析：本题考查的是何首乌的主治病证。肝肾不足，肾精不固，宜用何首乌（C对）。何首乌：【主治病证】（1）精血不足之头晕眼花、须发早白、腰酸脚软、遗精、崩漏、带下。（2）疮肿，瘰疬。（3）体虚久疟。（4）肠燥便秘。当归（A错）：【主治病证】（1）血虚萎黄、眩晕心悸。（2）月经不调，闭经，痛经。（3）虚寒腹痛，瘀血作痛，跌打损伤，痹痛麻木。（4）痈疽疮疡。（5）血虚肠燥便秘。龙眼肉（B错）：【主治病证】（1）心脾两虚之心悸怔忡、失眠健忘。（2）气血不足证。白芍（D错）：【主治病证】（1）血虚萎黄，月经不调，痛经，崩漏。（2）阴虚盗汗，表虚自汗。（3）肝脾不和之胸胁脘腹疼痛，或四肢拘急作痛。（4）肝阳上亢之头痛眩晕。阿胶（E错）：【主治病证】（1）血虚眩晕、心悸。（2）吐血，衄血，便血，崩漏，妊娠胎漏。（3）阴虚燥咳或虚劳喘咳。（4）阴虚心烦、失眠。